关于安宫牛黄丸的说法，错误的是
A. 功能清热解毒，止疼安神
B. 主治邪入心包，高热惊厥
C. 服药期间忌食辛辣油腻食物
D. 由闭证转为脱证者应立即停药
E. 肝肾功能不全者慎用

正确答案：A。功能清热解毒，止疼安神

解析：本题考查的是安宫牛黄丸的功能、主治与注意事项。安宫牛黄丸功能清热解毒，镇惊开窍（A错，为本题正确答案）。安宫牛黄丸：【功能】清热解毒，镇惊开窍。【主治】热病，邪入心包，高热惊厥（B对），神昏谵语；中风昏迷及脑炎、脑膜炎、中毒性脑病、脑出血、败血症见上述证候者。【注意事项】孕妇禁用。寒闭神昏者不宜使用。因其含有毒的朱砂、雄黄，故不宜过量服用或久服，肝肾功能不全者慎用（E对）。服药期间，忌食辛辣食物（C对）。在治疗过程中如出现肢寒畏冷、面色苍白、冷汗不止、脉微欲绝，由闭证变为脱证者应立即停药（D对）。高热神昏、中风昏迷等口服本品困难者，当鼻饲给药。